某女，25岁。患月经不调，经水量少、淋沥不净。治当活血调经，宜选用的成药是
A. 妇炎平胶囊
B. 益母草胶囊
C. 千金止带丸
D. 宫血宁胶囊
E. 妇科千金片

正确答案：B。益母草胶囊

解析：本题考查的是益母草胶囊的功能。治当活血调经，宜选用的成药是益母草胶囊（B对）。益母草胶囊【功能】活血调经。妇炎平胶囊（A错）【功能】清热解毒，燥湿止带，杀虫止痒。千金止带丸（C错）【功能】健脾补肾，调经止带。宫血宁胶囊（D错）【功能】凉血止血，清热除湿，化瘀止痛。妇科千金片（E错）【功能】清热除湿，益气化瘀。